采用发酵法炮制药物时，适宜的温度和相对湿度是
A. 30℃～37℃，70%～80%
B. 15℃～20℃，45%～55%
C. 18℃～25℃，65%～75%
D. 30℃～37℃，65%～75%
E. 18℃～25℃，70%～80%

正确答案：A。30℃～37℃，70%～80%

解析：本题考查的是发酵法。采用发酵法炮制药物时，适宜的温度和相对湿度是30℃～37℃，70%～80%（A对）。发酵法属于中药特殊的炮制方法之一，指经净制或处理后的药物，在一定的温度和湿度条件下，利用霉菌和酶的催化分解作用，使药物发泡、生衣的方法。发酵的主要目的：①改变原有性能，产生新的治疗作用，扩大药用品种，如六神曲、建神曲、淡豆豉等。②增强疗效。如半夏曲。一般发酵的最佳温度为30℃～37℃。一般发酵的相对湿度应控制在70%～80%。